根据医疗保险用药管理的相关规定，在国家基本医疗保险药品目录中，即列出了基本医疗保险、工伤保险和生育保险基金准予支付的品种，又列出了不得纳入基金支付范围的品种的是
A. 中药饮片
B. 血液制品
C. 中成药
D. 口服泡腾剂

正确答案：A。中药饮片

解析：本题考查的是医保药品目录分类。根据医疗保险用药管理的相关规定，在国家基本医疗保险药品目录中，即列出了基本医疗保险、工伤保险和生育保险基金准予支付的品种，又列出了不得纳入基金支付范围的品种的是中药饮片（A对）。医保药品目录分类：医保药品目录分“甲类目录”和“乙类目录”。“甲类目录”的药品是临床治疗必需，使用广泛，疗效好，同类药品中价格低的药品。“乙类目录”的药品是可供临床治疗选择使用，疗效好，同类药品中比“甲类目录”药品价格略高的药品。医保目录调入分为常规准入和谈判准入两种方式。在满足有效性、安全性等前提下，价格（费用）与药品目录内现有品种相当或较低的，可以通过常规方式纳入目录；价格较高或对医保基金影响较大的专利独家药品应当通过谈判方式准入。《国家基本医疗保险、工伤保险和生育保险药品目录》列入品种为常规准入药品。目录共分为凡例、西药、中成药、协议期内谈判药品、中药饮片五部分。西药部分包括了化学药品和生物制品；中成药部分包含了中成药（C错）和民族药；协议期内谈判药品部分包括了尚处于谈判协议有效期内的药品。西药、中成药和协议期内谈判药品分甲乙类管理，协议期内谈判药品按照乙类支付。医保药品目录中列出了基本医疗保险、工伤保险和生育保险基金准予支付的中药饮片，同时列出了不得纳入基金支付的饮片范围。同时，目录包括限工伤保险基金准予支付费用的品种、限生育保险基金准予支付费用的品种。工伤保险和生育保险支付药品费用时不区分甲、乙类。不得纳入基本医疗保险用药范围的药品：根据《城镇职工基本医疗保险用药范围管理暂行办法》第四条，不能纳入基本医疗保险用药范围的药品包括：①主要起营养滋补作用的药品；②部分可以入药的动物及动物脏器，干（水）果类；③用中药材和中药饮片泡制的各类酒制剂；④各类药品中的果味制剂、口服泡腾剂（D错）；⑤血液制品（B错）、蛋白类制品（特殊适应症与急救、抢救除外）；⑥劳动保障部规定基本医疗保险基金不予支付的其他药品。